对于余留牙的保留，下列情况中哪项应该考虑拔除
A. 牙槽骨吸收达达到根1/5
B. 牙槽骨吸收达达到根2/5
C. 牙槽骨吸收达达到根1/3
D. 牙槽骨吸收达达到根2/3
E. 牙槽骨吸收达达到根1/2

正确答案：D。牙槽骨吸收达达到根2/3

解析：本题考查余留牙中松动牙的保留与拔除。牙槽骨吸收达达到根2/3（D对）的情况应该考虑拔除。一般来说，对于牙槽骨吸收达到根2/3以上，牙松动达Ⅲ度者予以拔除；对未达到这一严重程度的松动牙，经有效治疗后尽量予以保留。